关于酸蚀作用描述哪项是错误的
A. 去除表层玷污釉质，起到机械清洁作用
B. 增加釉质表面自由能
C. 能增强釉质与充填材料化学结合能力
D. 增加牙齿表面积和粗糙度
E. 活化釉质表层

正确答案：C。能增强釉质与充填材料化学结合能力

解析：本题考查酸蚀的作用。釉质粘接是通过磷酸酸蚀技术实现的，该技术通过酸蚀釉质表面层，使粘结树脂获得微机械固位（C错，为本题的正确答案）。酸蚀作用有：（1）酸溶解釉质表面的羟磷灰石，暴露出釉质新鲜层（A对），有利于粘结剂与其结合。（2）增大釉质表面可湿性和表面自由能（B对），有利于粘结剂的渗入。（3）酸蚀后牙釉质表面形成蜂窝状突起，可增加釉质表面的粘接面积和粗糙度（D对）。（4）酸蚀还可以活化釉质表层（E对），经酸处理后，釉质表面的极性增强，易与粘接树脂结合。